雄激素的临床用途有
A. 功能性子宫出血
B. 子宫肌瘤
C. 前列腺癌
D. 再生障碍性贫血
E. 痤疮（粉刺）

正确答案：A、B、D。功能性子宫出血；子宫肌瘤；再生障碍性贫血

解析：本题考查雄激素。雄激素的临床用途有功能性子宫出血（A对）、子宫肌瘤（B对）、再生障碍性贫血（D对）。雄激素禁用于对已确诊或怀疑为前列腺癌者（C错）。痤疮（E错）是青春发育期由于雄激素增多，致皮脂腺毛囊管壁角化并堵塞毛孔造成皮脂排出不畅，引起毛囊皮脂腺的炎症反应，雄激素不可用于痤疮治疗。